含可致味觉障碍副作用巯基的ACE抑制剂是
A. 赖诺普利
B. 福辛普利
C. 马来酸依那普利
D. 卡托普利
E. 雷米普利

正确答案：D。卡托普利

解析：本题考查卡托普利。含可致味觉障碍副作用巯基的ACE抑制剂是卡托普利（D对）。赖诺普利（A错）、福辛普利（B错）、马来酸依那普利（C错）、雷米普利（E错）结构中不含巯基。